患者，男，60岁。腹胀大如鼓，按之如囊裹水，有波动感。应首先考虑的是
A. 水饮
B. 痞满
C. 积聚
D. 水臌
E. 内痈

正确答案：D。水臌

解析：腹部高度胀大，如鼓之状者，称为鼓胀。可分水臌和气臌。按之如囊裹水，有波动感者为水臌（D对）。脘部按之有形而胀痛，推之辘辘有声者，为胃中有水饮（A错）。自觉心下或胃脘部痞塞不适和胀满，即为痞满（B错）。腹内结块，或肿或痛，见症不一，即为积聚（C错）。按之局部灼热，痛不可忍者，即为内痈（E错）。